男，因皮肤病曾有长期服用激素病史，近2年双髋关节疼痛活动受限。初步诊断是
A. 双髋类风湿性关节炎
B. 双髋创伤性滑膜炎
C. 双髋退变性关节骨关节炎
D. 双侧股骨头缺血性坏死
E. 双侧髋关节肿瘤性病变

正确答案：D。双侧股骨头缺血性坏死

解析：患者长期服用激素药物，可引起：①机体脂代谢紊乱，可引起脂肪肝和高脂血症，脂肪肝可引起软骨下骨内小血管脂肪栓塞；②诱发微小血管炎，并使血黏度增加，易形成血栓造成骨内微循环障碍，小静脉内血栓和脂肪填塞静脉窦，使得髓内压力增高；③蛋白和胶原的合成障碍，使骨基质代谢受到明显损害，从而引起骨质疏松。在这些变化的共同作用下，易发生骨坏死，最常见于股骨头、其次为肱骨头。本例患者双髋关节疼痛、活动受限，故初步诊断是双侧股骨头缺血性坏死（D对）。类风湿性关节炎（P766）（A错）主要累及近端指间关节、掌指关节等小关节，极少累计大关节，如髋关节。创伤性滑膜炎（B错）常表现为局部圆形或椭圆形肿块，缓慢增大伴压痛。退变性骨关节炎（C错）好发于中老年女性，表现为晨起僵硬、疼痛、活动后缓解。髋关节肿瘤性病变（E错）常可见骨质的破坏，且与使用激素史关系不大。